某男患者，65岁。患胃癌四年，晚期，已失去手术治疗价值，生命垂危。家属再三恳求医生，希望能满足病人心理上的渴求，收他入院。医生出于“人道”，将他破格地收入院。究竟该不该收治这个病人。从医务人员的义务出发，下列除外哪点都是应该收治的
A. 医务人员有诊治患者的责任
B. 医务人员有解除患者痛苦的责任
C. 医务人员应无条件忠实于患者利益的责任
D. 晚期癌症，治好无望，不收也是符合医德要求的
E. 对治疗无望的临危患者，应收入医院进行治疗，目的是尊重人的生命价值

正确答案：D。晚期癌症，治好无望，不收也是符合医德要求的